与颅内静脉有交通的是
A. 内眦静脉
B. 头静脉
C. 奇静脉
D. 附脐静脉
E. 大隐静脉

正确答案：A。内眦静脉

解析：内眦静脉（A对）发出面静脉，面静脉通过眼上静脉和眼下静脉与颅内的海绵窦交通，并通过面深静脉与翼静脉丛交通，继而与海绵窦交通。